塑料基托厚度一般为
A. 0.5mm
B. 1.0mm
C. 1.5mm
D. 2.0mm
E. 3.0mm

正确答案：D。2.0mm

解析：本题考查塑料基托的厚度。塑料基托厚度一般为2.0mm（D对），应有一定的厚度保持其抗挠曲强度，过薄易折裂，过厚不舒适。金属基托由于其机械性能好，能承担较大（牙合）力而不致变形、折裂，故厚度一般为0.5mm（A错），边缘可稍厚至1.0mm（B错）。